符合小叶性肺炎炎性特点的是
A. 以浆液渗出为主
B. 以纤维素渗出为主
C. 以淋巴细胞渗出为主
D. 以中性粒细胞渗出为主
E. 以嗜酸性粒细胞渗出为主

正确答案：D。以中性粒细胞渗出为主

解析：小叶性肺炎的病理特征是以中性粒细胞渗出为主的化脓性炎（D对）。以浆液渗出为主（A错）的炎性改变为浆液性炎的病理特征。以纤维素渗出为主（B错）的病理改变是大叶性肺炎的特征。以淋巴细胞渗出为主（C错）是慢性炎症的病理特征。以嗜酸性粒细胞渗出为主（E错）多见于寄生虫及IgE介导的炎症反应。